根据《处方管理办法》，为门诊一般患者开具头孢克洛缓释片，每张处方
A. 不得超过15日常用量
B. 不得超过7日常用量
C. 为一次常用量
D. 不得超过3日常用量

正确答案：B。不得超过7日常用量

解析：本题考查处方的开具管理。根据《处方管理办法》，为门诊一般患者开具头孢克洛缓释片，每张处方不得超过7日常用量（B对）。处方一般不得超过7日用量；急诊处方一般不得超过3日用量（D错）。第一类精神药品注射剂，每张处方为一次常用量（C错）。哌醋甲酯用于治疗儿童多动症时，每张处方不得超过15日常用量（A错）。